输液时须遵循三查七对原则，以下不属于七对的是
A. 姓名
B. 性别
C. 剂量
D. 药物
E. 床号

正确答案：B。性别

解析：输液三查七对的内容，三查是指：操作前查、操作中查、操作后查，七对指的是：查对床号（E对）、查对姓名（A对）、查对药名（D对）、查对剂量（C对）、查对时间、查对浓度、查对用法。（B错，为此题正确答案）